肝硬化出现腹水和水肿时，血清清蛋白一般低于
A. 35g/L
B. 30g/L
C. 25g/L
D. 20g/L
E. 15g/L

正确答案：B。30g/L